从事高空作业者禁用的药是
A. 风寒感冒冲剂
B. 贯防感冒片
C. 桑菊感冒片
D. 羚翘解毒丸
E. 银翘解毒片

正确答案：B。贯防感冒片